男性，30岁，1年前下岗。近5个月来觉得邻居都在议论他，常不怀好意地盯着他，有时对着窗外大骂，自语自笑，整天闭门不出，拨110电话要求保护。有诊断意义的症状还包括
A. 思维奔逸
B. 意识障碍
C. 木僵
D. 自杀
E. 妄想知觉

正确答案：E。妄想知觉

解析：该病例患者中年男性，1年前下岗。近5个月来觉得邻居都在议论他（幻听），常不怀好意地盯着他（妄想），闭门不出（妄想、幻觉的支配下所表现的行为），故诊断为精神分裂症偏执型，妄想知觉对诊断精神分裂症具有重要价值（E对）。思维奔逸患者表现为特别健谈，说话滔滔不绝，多见于躁狂发作（A错）。意识障碍主要见于脑器质性精神障碍（B错）。木僵多见于紧张型精神分裂症（C错）。